肾综合征出血热的病原体是
A. 炭疽芽胞杆菌
B. 溶脲脲原体
C. 柯萨奇B组病毒
D. 伯氏球螺旋体
E. 汉坦病毒

正确答案：E。汉坦病毒

解析：肾综合征出血热（流行性出血热）的病原体是汉坦病毒（E对），具有地区性和季节性，以10～12月份为多见，与鼠类的分布与活动有关，携带病毒的鼠（如黑线姬鼠），通过唾液、尿、粪污染环境，人经呼吸道、消化道或直接接触等方式被传染，病毒导致全身毛细血管内皮细胞和小血管损伤，引起高热、出血、肾脏损害和免疫功能紊乱的临床表现。炭疽芽胞杆菌（A错）可引起炭疽；溶脲脲原体（B错）亦称解脲脲原体，是人类泌尿生殖道常见的寄生菌之一，常引起人类非淋菌性尿道炎，在特定环境下可致病；柯萨奇B组病毒（C错）是人类病毒性心肌炎的重要病原体；伯氏球螺旋体（D错）可致莱姆病（P267）。